某女，40岁。少腹有包块2年，逐渐增大，3个月前闭经，至今未行，现见面黑色，潮热赢瘦，肌肤甲错。证属瘀血内停所致的癥瘕、经闭，治当活血破瘀消癥，宜选用的成药是
A. 女金丸
B. 乌鸡白凤丸
C. 大黄䗪虫丸
D. 七制香附丸
E. 少腹逐瘀丸

正确答案：C。大黄䗪虫丸

解析：本题考查的是大黄䗪虫丸的主治。少腹有包块2年，逐渐增大，3个月前闭经，至今未行，现见面黑色，潮热赢瘦，肌肤甲错。证属瘀血内停所致的癥瘕、经闭，治当活血破瘀消癥，宜选用的成药是大黄䗪虫丸（C对）。大黄䗪虫丸：【主治】瘀血内停所致的癥瘕、闭经，症见腹部肿块、肌肤甲错、面色黯黑、潮热羸瘦、经闭不行。女金丸（A错）：【主治】气血两虚、气滞血瘀所致的月经不调，症见月经提前、月经错后、月经量多、神疲乏力、经水淋漓不净、行经腹痛。乌鸡白凤丸（B错）：【主治】气血两虚，身体瘦弱，腰膝酸软，月经不调，崩漏带下。七制香附丸（D错）：【主治】气滞血虚所致的痛经、月经量少、闭经，症见胸胁胀痛、经行量少、行经小腹胀痛、经前双乳胀痛、经水数月不行。少腹逐瘀丸（E错）：【主治】寒凝血瘀所致的月经后期、痛经、产后腹痛，症见行经后错、经行小腹冷痛、经血紫黯、有血块、产后小腹疼痛喜热、拒按。